以下对化疗中冲击疗法的描述，不正确的是
A. 大剂量一次给药
B. 给药间隔在3个月以上
C. 疗效比每日小剂量用药疗效好
D. 不易出现耐药性
E. 年老、体弱者慎用

正确答案：B。给药间隔在3个月以上

解析：冲击疗法：大剂量一次冲击治疗。通常指给药间隔在3周以上者。这一方案可以利用药物的最大杀伤能力，比每日小剂量用药疗效显著为好。冲击疗法的毒性，特别是对骨髓的抑制并不比小剂量给药为大，且不易出现耐药性；对免疫功能的影响亦较小，但对老年、体弱的患者应慎重使用，而且应在有解毒药的条件下配合应用。掌握“口腔颌面部肿瘤的治疗原则及预防”知识点。